股骨颈骨折时，股骨头缺血性坏死率最高的是
A. 完全性头下骨折
B. 不完全性股骨颈骨折
C. 完全性基底骨折
D. 不完全性经颈骨折
E. 完全性股骨颈骨折

正确答案：A。完全性头下骨折

解析：股骨头血液供应来源有小凹动脉、股骨干滋养动脉升支和旋股内、外侧动脉。骺外侧动脉是旋股内侧动脉的分支，供应股骨头2/3～4/5区域的血液循环，是股骨头最主要的供血来源。完全性股骨头下骨折（A对）时，骺外侧动脉易发生中断，使得股骨头仅剩小凹动脉的少量血供，故易发生缺血性骨坏死。股骨颈基底骨折（BC错）的骨折线位于股骨颈与大、小转子间连线处，尚有旋骨内外侧动脉分支吻合的动脉环提供血液循环，故对骨折部血液供应的干扰较小，不易发生缺血性骨坏死。经股骨颈骨折（DE错）发生股骨头缺血坏死的几率较头下型低。